躯干、四肢痛、温觉传导路第1级神经元在
A. 脊神经节
B. 脑干
C. 丘脑腹后外侧核
D. 丘脑腹后内侧核
E. 薄束核楔束核

正确答案：A。脊神经节

解析：参与传导躯干和四肢痛温觉和粗略触觉压觉的结构包括第1级神经元：脊神经节细胞（A对），第2级神经元：脊髓灰质第I、Ⅳ、VII层神经细胞，第3级神经元：丘脑腹后外侧核，最后经内囊后肢投射到中央后回中、上部和中央旁小叶后部。